重度妊娠高血压综合征孕妇剧烈头痛伴呕吐时首选药物治疗应是
A. 硫酸镁静脉滴注
B. 哌替啶肌内注射
C. 肼苯达嗪静脉滴注
D. 甘露醇快速静滴
E. 氯丙嗪静脉推注

正确答案：D。甘露醇快速静滴

解析：重度妊娠高血压综合征孕妇头痛剧烈伴呕吐时首选甘露醇快速静滴（D对）。孕妇头痛剧烈伴呕吐说明颅内压增高，脑水肿可能引发脑疝等严重并发症，此时应快速静滴甘露醇降低颅内压。硫酸镁（A错）是预防及治疗子痫的首选用药，但本孕妇剧烈头痛同时伴呕吐，颅内压增高症状明显，需要尽快降低颅内压。肼苯达嗪（C错）降舒张压比降收缩压明显，目前主要用于肾性高血压和舒张压高者。氯丙嗪静脉推注（E错）主要和哌替啶（B错）、异丙嗪组成冬眠合剂控制子痫抽搐。此题有争议，但笔者认为题目所给症状指示颅内压增高的可能性较大，已出现利尿指征，故用甘露醇快速静滴。